当患者要求住院医师开具精神药品时，该医师应当遵循的伦理要求是
A. 严守法规
B. 公正分配
C. 加强协作
D. 合理配伍
E. 对症下药

正确答案：A。严守法规

解析：当患者要求住院医师开具精神药品时，应严格遵守《麻醉药品和精神药品管理条例》，故医师应当遵循的伦理要求是严守法规（A对）。对症下药（E错）是医生根据临床诊断选择相应的药物进行治疗遵循的医学伦理学要求。合理配伍（D错）是药物治疗对医生的道德要求。